高血压时的肾脏病理变化表现为
A. 颗粒型固缩肾
B. 肾脏单发性贫血性梗死
C. 肾动脉动脉瘤形成
D. 肾的多发性大瘢痕形成
E. 肾脏淤血

正确答案：A。颗粒型固缩肾

解析：高血压时，由于肾入球小动脉的玻璃样变和肌型小动脉的硬化，导致部分肾单位纤维化、萎缩，部分肾单位代偿性肥大、扩张，肉眼观，双肾对称性缩小，质地变硬，表面凹凸不平，呈细颗粒状，称为原发性颗粒性固缩肾（A对）。肾脏单发性贫血性梗死（B错）及肾的多发性大瘢痕形成（D错）均可见于肾动脉粥样硬化（P137），称为动脉粥样硬化性固缩肾，当动脉粥样硬化程度严重时，可造成肾动脉动脉瘤形成（C错）。肾脏淤血（E错）可见于多种肾脏损伤和疾病，不是特异性病理改变。